根据妇女的特殊生理特点，女职工劳动保护的重点“四期”是
A. 青春期、孕期、哺乳期、更年期
B. 经期、孕期、产期、哺乳期
C. 经期、孕期、产期、更年期
D. 青春期、新婚期、孕期、哺乳期
E. 新婚期、孕期、哺乳期、更年期

正确答案：B。经期、孕期、产期、哺乳期